受体增敏表现为
A. 长期使用一种受体的激动药后，该受体对激动药的敏感性下降
B. 长期使用一种受体的激动药后，该受体对激动药的敏感性增强
C. 长期使用受体拮抗药后，受体数量或受体对激动药的敏感性增加
D. 受体对一种类型受体的激动药反应下降，对其他类型受体激动药的反应也不敏感
E. 受体只对一种类型的激动药的反应下降，而对其他类型受体激动药的反应不变

正确答案：C。长期使用受体拮抗药后，受体数量或受体对激动药的敏感性增加

解析：本题考查作用于受体药物的分类。受体增敏表现为长期使用受体拮抗药后，受体数量或受体对激动药的敏感性增加（C对）。受体增敏是指长期应用拮抗药，造成受体数量或敏感性提高。长期使用一种受体的激动药后，该受体对激动药的敏感性下降（A错）的是受体脱敏。受体对一种类型受体的激动药反应下降，对其他类型受体激动药的反应也不敏感（D错）的是异源脱敏。受体只对一种类型的激动药的反应下降，而对其他类型受体激动药的反应不变（E错）的是同源脱敏。